建筑材料与装饰材料会把污染物带入公共场所其中值得注意的是
A. 甲醛和氨
B. 甲醇和氡
C. 甲醛和氡
D. 甲醇和氨
E. 甲醛和镭

正确答案：C。甲醛和氡

解析：本题考查建筑材料与装饰材料中会带入公共场所的污染物。建筑材料与装饰材料会把污染物带入公共场所，其中值得注意的是甲醛和氡（C对ABDE错）。甲醛对人体有刺激、致敏作用，或可引起全身作用，长期接触高浓度的氡及其子体可以引起肺癌。